属于孕晚期保健主要内容的是
A. 预防胎儿发育畸形
B. 指导产妇胎教
C. 筛查胎儿畸形
D. 预防妊娠并发症
E. 筛查妊娠并发症

正确答案：E。筛查妊娠并发症

解析：本题考查孕晚期保健的主要内容。由于妊娠晚期随着胎儿的生长发育，孕妇发生了生理变化，生殖器官、内分泌、心血管、呼吸系统、泌尿系统、神经系统等发生了变化，孕妇及胎儿易发生并发症，如妊娠期高血压疾病、胎盘早剥、胎儿宫内窘迫等，所以筛查妊娠并发症（E对ABCD错）是孕晚期保健主要内容。